含牙囊肿的定义是
A. 囊壁包含一个未萌出牙的牙根
B. 囊壁包含一个发育异常的牙体
C. 囊壁包含一个未萌出的牙体
D. 囊壁包含一个已萌出牙的牙根
E. 囊壁包含一个未萌出牙的牙冠

正确答案：E。囊壁包含一个未萌出牙的牙冠

解析：含牙囊肿又称滤泡囊肿，是指囊壁包含一个未萌牙的牙冠并附着于该牙的牙颈部的囊肿。多发生于10～39岁男性患者，下颌第三磨牙区最常见。掌握“牙源性囊肿”知识点。